男，33岁。咳嗽、痰中带血伴乏力2周。胸部X线片显示左上肺少量斑片状阴影，可见少许不规则透亮区，未见液平。为明确诊断宜首先采取的措施是
A. 痰涂片抗酸染色
B. 痰细菌培养+药敏
C. 痰细胞学检查
D. 痰涂片找真菌
E. 痰涂片找含铁血黄素细胞

正确答案：A。痰涂片抗酸染色

解析：患者咳嗽、痰中带血伴乏力2周（为肺结核的典型临床表现），胸部X线显示左上肺斑片状阴影，见少许不规则透亮区，根据其临床表现和辅助检查，考虑诊断为肺结核。痰结核分枝杆菌检查是确诊肺结核的主要方法，结核分枝杆菌为抗酸杆菌，具有抗酸性，故为明确诊断宜首先采取的措施是痰涂片抗酸染色（A对）。痰涂片找含铁血黄素细胞（E错），表明有红细胞破坏和全身性或局限性含铁物质的剩余，见于心衰细胞和肺褐色硬化，故痰涂片找含铁血黄素细胞不能诊断肺结核。痰细菌培养+药敏（B错）虽可以确诊肺结核，但培养费时较长，一般为2～8周，故不作为首先采取的措施。痰细胞学检查（C错）是诊断呼吸系统肿瘤的重要方法。结核分枝杆菌不是真菌，故痰涂片找真菌（D错）不能确诊肺结核。